明代对药学贡献最大的本草著作是
A. 《新修本草》
B. 《证类本草》
C. 《图经本草》
D. 《本草纲目》
E. 《植物名实图考》

正确答案：D。《本草纲目》

解析：本题考查的是历代本草代表作。明代对药学贡献最大的本草著作是《本草纲目》（D对）。《本草纲目》：简称《纲目》，为明代本草代表作。该书不仅集我国16世纪以前药学成就之大成，将本草学的发展提高到一个空前的高度，而且在生物、化学、天文、地理、地质、采矿等方面也有突出的成就，对世界医药学和自然科学的许多领域做出了举世公认的卓越贡献。《新修本草》（A错）：又称《唐本草》，为隋唐时期唐代的本草代表作。本书是我国历史上第一部官修药典性本草，并被今人誉为世界上第一部药典。该书无论在内容和编写形式上都有新的突破，全面总结了唐以前的药物学成就，并很快流传下海内外，对后世医药学的发展影响极大。《证类本草》（B错）：即《经史证类备急本草》，为宋金元时期宋代的本草代表作。作者唐慎微，以掌禹锡的《嘉祐本草》和苏颂的《图经本草》（C错）为基础，并收集转录了大量宋以前各代名医对本草的真知灼见、经史传记和佛书道藏中有关本草的论述以及民间防治疾病的经验和单方，撰成此书。该书图文对照，方药并收，医药结合，资料翔实，集宋以前本草之大成，使大量古代文献得以保存，具有极高的学术价值和文献价值。《植物名实图考》（E错），2022年考试指南未明确说明。